代谢性酸中毒可出现的呼吸改变是
A. 潮式呼吸
B. 叹息样呼吸
C. 库斯莫尔呼吸
D. 比奥呼吸
E. 抽泣样呼吸

正确答案：C。库斯莫尔呼吸

解析：代谢性酸中毒可出现Kussmaul呼吸（库斯莫尔呼吸）（C对），表现为深长而规则的呼吸，可伴有鼾音，称为酸中毒大呼吸。潮式呼吸（又称间停呼吸）（A错）见于吗啡类、巴比妥类等中枢抑制药物和有机磷杀虫药中毒。叹息样呼吸（B错）见于焦虑症、癔症患者。比奥呼吸（D错）见于脑干受压。抽泣样呼吸（E错）见于重症颅脑疾病，如脑出血、脑炎、脑膜炎等。